以下不属于β肾上腺素受体阻断药的分类
A. 非选择性β肾上腺素受体阻断药
B. 选择性β肾上腺素受体阻断药
C. 有内在拟交感活性β肾上腺素受体阻断药
D. 无内在拟交感活性β肾上腺素受体阻断药
E. 异丙肾上腺素

正确答案：E。异丙肾上腺素

解析：β肾上腺素受体阻断药可根据其选择性分为非选择性的（β1、β2受体阻断药）和选择性的（β1受体阻断药）两类。本类药物中有些除具有β受体阻断作用外，还具有一定的内在拟交感活性，因此上述两类药物又可分为有内在拟交感活性及无内在拟交感活性两类。掌握“β肾上腺素受体阻断剂”知识点。